子宫腔
A. 即子宫底扩大的腔隙
B. 呈底朝下的三角形
C. 三角形的尖为子宫口
D. 仅是孕育胎儿的场所
E. 底的两侧借输卵管子宫口与输卵管相通

正确答案：E。底的两侧借输卵管子宫口与输卵管相通

解析：子宫子宫壁厚、腔小，是孕育胚胎、胎儿和产生月经的肌性器官（AD错），呈前后扁的倒三角形（B错），尖端向下续为子宫颈管宫颈管呈梭形，下口通阴道，称为子宫口（C错），底的两侧借输卵管子宫口与输卵管相通（E对）。